下述液体药剂附加剂的作用为：苯甲酸
A. 极性溶剂
B. 非极性溶剂
C. 防腐剂
D. 矫味剂
E. 半极性溶剂

正确答案：C。防腐剂

解析：本题考查液体制剂常用的附加剂。苯甲酸可作为防腐剂（C对）。常用的防腐剂有：①苯甲酸与苯甲酸钠； ②对羟基苯甲酸酯类 ；③山梨酸与山梨酸钾；④苯扎溴铵等。